大学生心理问题的发生率估计在
A. 0.13
B. 0.16
C. 0.2
D. 0.24
E. 0.32

正确答案：B。0.16

解析：小学生的心理问题的发生率估计在13％左右，主要问题是学习问题、品行问题、教育问题。中学生的心理问题发生率估计在20％左右，主要是学习问题、人际关系问题、恋爱问题、教育问题等。大学生心理问题的发生率估计在16％左右，主要问题是学习问题、人际关系问题、恋爱与性问题等。掌握“不同年龄阶段心理卫生”知识点。